骨盆的组成不包括
A. 骶骨
B. 尾骨
C. 坐骨
D. 第五腰椎
E. 髂骨

正确答案：D。第五腰椎

解析：第五腰椎为脊柱结构（D错，为本题正确答案）。骨盆的骨骼包括骶骨（A对）、尾骨（B对）、及左右两块髋骨。每块髋骨又包括髂骨（E对）、坐骨（C对）和耻骨。